女性，28岁，已婚，妊娠14周。因消瘦、乏力、多食、心悸3个月就诊。查体：皮温升高，手震颤，实验室检查TSH降低。下述哪项体征最有诊断意义
A. 心动过速
B. 双手震颤
C. 双眼裂增宽
D. 皮肤潮润
E. 甲状腺Ⅱ度肿大，双上极可闻及血管杂音

正确答案：E。甲状腺Ⅱ度肿大，双上极可闻及血管杂音

解析：青年女性患者，妊娠14周，消瘦、乏力、多食、心悸3个月（甲亢典型的高代谢症状），查体：皮温升高，手震颤（典型的高代谢体征），实验室检查TSH降低（甲亢的诊断指标之一），结合该患者的临床表现、体征及试验室检查，该患者的诊断考虑为甲亢，甲状腺肿大是甲亢确诊的条件之一。而心动过速、双手震颤、双眼裂增宽及皮肤潮湿都属于高代谢体征和症状，但是考虑到患者是妊娠期妇女，妊娠期女性多伴有高代谢的症状和体征，所以具有诊断意义的应该是甲状腺肿大（E对）。